女孩，1岁半。虚胖，面色蜡黄数月，肝脾肿大，肢体和头部不规则震颤，甚至抽搐，肌张力增强。治疗该患儿主要的药物是
A. 维生素C
B. 维生素B₁₂
C. 铁剂
D. 铁剂加叶酸
E. 泼尼松

正确答案：B。维生素B₁₂

解析：该患儿主要的治疗药物应是维生素B12。维生素C（A错）主要治疗和预防小儿坏血病，对贫血治疗作用并不大。根据本题患儿临床表现：虚胖，面色蜡黄数月，肝脾肿大，肢体和头部不规则震颤，甚至抽搐，肌张力增强。我们应诊断该小儿为营养性巨幼细胞性贫血，营养性巨幼细胞性贫血有精神症状者，应以维生素B12（B对）治疗为主，加用叶酸（D错）反而有加重症状的可能。缺铁性贫血临床上没有严重的中枢神经系统症状，仅仅表现为烦躁不安，精神不易集中，记忆力、智力减退，故而不能诊断为缺铁性贫血，因此补充铁剂（C错）对本题中患儿并无太好作用。泼尼松（E错）对小儿营养性巨幼细胞性贫血没有治疗作用。